正中神经支配
A. 斜角肌
B. 肱肌
C. 肱桡肌
D. 三角肌
E. 指深屈肌

正确答案：E。指深屈肌

解析：正中神经支配指深屈肌（E对）。斜角肌（A错）由颈神经前支支配；肱肌（B错）由肌皮神经支配；肱桡肌（C错）由桡神经支配；三角肌（D错）由腋神经支配。